妇女保健工作的意义是
A. 妇女一生生殖功能变化复杂，所以要做好妇女保健工作
B. 妇女的健康直接关系到子代的健康
C. 妇女保健工作关系到妇女本人的身体健康
D. 妇女的健康直接关系到家庭和整个社会的健康水平
E. 以上答案都对

正确答案：E。以上答案都对

解析：本题考查妇女保健工作的意义。妇女保健工作的意义：1.妇女一生生殖功能变化复杂，所以要做好妇女保健工作；2.妇女的健康直接关系到子代的健康；3.妇女保健工作关系到妇女本人的身体健康；4.妇女的健康直接关系到家庭和整个社会的健康水平（E对ABCD错）。